每分通气量和肺泡通气量之差等于
A. 潮气量×呼吸频率
B. 功能余气量×呼吸频率
C. 余气量×呼吸频率
D. 无效腔气量×呼吸频率
E. 肺活量×呼吸频率

正确答案：D。无效腔气量×呼吸频率

解析：肺泡通气量=（潮气量-无效腔气量）×呼吸频率=潮气量×呼吸频率-无效腔气量×呼吸频率。每分通气量=潮气量×呼吸频率。每分通气量和肺泡通气量之差即每分通气量-肺泡通气量=潮气量×呼吸频率-（潮气量×呼吸频率-无效腔气量×呼吸频率）=无效腔气量×呼吸频率（D对）。